下列情形属于违法情形的有
A. 王某在国外购买两瓶降压药，准备回国自用，并如实向海关申报
B. 甲公司在药品说明书适应症下擅自添加“治疗糖尿病”的表述
C. 李某在城乡集贸市场出售自家种植的中药材
D. 乙药店销售的川贝母未标明产地
E. 丙医疗机构发布其自制制剂的广告

正确答案：B、D、E。甲公司在药品说明书适应症下擅自添加“治疗糖尿病”的表述；乙药店销售的川贝母未标明产地；丙医疗机构发布其自制制剂的广告

解析：本题考查药品管理。下列情形属于违法情形的有甲公司在药品说明书适应症下擅自添加“治疗糖尿病”的表述（B错，为本题正确答案）；乙药店销售的川贝母未标明产地（D错，为本题正确答案）；丙医疗机构发布其自制制剂的广告（E错，为本题正确答案）。药品说明书、标签的核准内容：药品说明书和标签的内容由国家药品监督管理部门予以核准，药品生产企业印制时，应当按照国家药品监督管理局规定的格式和要求、根据核准的内容印制说明书和标签，不得擅自增加或删改原批准的内容。药品的标签应当以说明书为依据，其内容不得超出说明书的范围，不得印有暗示疗效、误导使用和不适当宣传产品的文字和标识。药品包装必须按照规定印有或者贴有标签，也不得夹带其他任何介绍或者宣传产品、企业的文字、音像及其他资料。因此，药品标签不得印制“××省专销”“原装正品”“进口原料”“驰名商标”“专利药品”“××监制”“××总经销”“××总代理”等字样。但是，“企业防伪标识”“企业识别码”“企业形象标志”等文字图案可以印制。以企业名称等作为标签底纹的，不得以突出显示某一名称来弱化药品通用名称。“印刷企业”“印刷批次”等与药品的使用无关的，不得在药品标签中标注。《中华人民共和国药品管理法》第五章药品经营第五十八条：药品经营企业零售药品应当准确无误，并正确说明用法、用量和注意事项；调配处方应当经过核对，对处方所列药品不得擅自更改或者代用。对有配伍禁忌或者超剂量的处方，应当拒绝调配；必要时，经处方医师更正或者重新签字，方可调配。药品经营企业销售中药材，应当标明产地。依法经过资格认定的药师或者其他药学技术人员负贵本企业的药品管理、处方审核和调配、合理用药指导等工作。不得发布广告的产品：按照规定，不得做广告的产品包括：①麻醉药品、精神药品、医疗用毒性药品、放射性药品、药品类易制毒化学品，以及戒毒治疗的药品、医疗器械；②军队特需药品、军队医疗机构配制的制剂；③医疗机构配制的制剂；④依法停止或者禁止生产、销售或者使用的药品、医疗器械、保健食品和特殊医学用途配方食品；⑤法律、行政法规禁止发布广告的情形。个人自用携带入境少量药品，按照国家有关规定办理。即个人自带少量亲属用、自用的入境，是法律允许的（A对），但个人自带少量药品入境后再销售就属于违法行为。《药品管理法》及其实施条例规定，城乡集市贸易市场可以出售中药材，国务院另有规定的除外（C对）。